上述各因素中最可能致肺癌的是
A. 长期饮用含藻类毒素的宅沟水或井水
B. 职业性接触石棉
C. 人乳头状瘤病毒18型感染
D. 职业性接触联苯胺
E. 职业性接触铅

正确答案：B。职业性接触石棉

解析：石棉不但可致肺组织纤维化（八年制预防医学第二版P105），引起石棉肺，且石棉可引起胸膜和腹膜恶性间皮瘤和肺癌（B对）。被污染的饮用水和含酒精饮料（流行病学第六版P382）：长期饮用含藻类毒素的宅沟水或井水的地区，可致当地肝癌发病率显著升高（A错）。人乳头状瘤病毒18型感染与宫颈癌有关（C错）。职业性接触联苯胺可引起膀胱癌（D错）。职业性接触铅可引起职业性铅中毒，多为慢性中毒（八年制预防医学第二版P75），早期表现为乏力、关节肌肉酸痛、胃肠道症状等，随着病情的进展出现神经、消化、血液等系统症状（E错）。